慢性肺源性心脏病肺心功能代偿期不具有的体征是
A. 肺气肿征
B. 肺动脉瓣区第二心音亢进
C. 颈静脉充盈
D. 剑突下心脏收缩期搏动
E. 右心室奔马律

正确答案：E。右心室奔马律

解析：慢性肺源性心脏病时，逐步出现肺、心功能障碍以及其他器官损害的征象，在肺、心功能代偿期的体征可有不同程度的发绀，原发肺脏疾病体征，如肺气肿体征（A对），干、湿性啰音，P₂＞A₂（B对），三尖瓣区可出现收缩期杂音或剑突下心脏搏动增强（D对）等。其中部分患者因肺气肿使胸内压升高，阻碍腔静脉回流，可有颈静脉充盈（C对）甚至怒张。而右心室奔马律（E错，为本题正确答案）为舒张期额外心音的一种，是出现在第二心音后的额外心音，是慢性肺源性心脏病肺、心功能失代偿期的体征之一，并不是代偿期的体征。